关于白三烯受体拮抗剂孟鲁司特用于哮喘防治的方法，错误的是
A. 可用于成人及儿童哮喘的防治和长期治疗
B. 不宜用于治疗急性哮喘发作
C. 应每晚睡前服用1次
D. 起效慢，一般连续应用4周显效
E. 2～5岁儿童剂量为5mg，每日一次

正确答案：E。2～5岁儿童剂量为5mg，每日一次

解析：本题考查孟鲁司特的用法用量。2～5岁儿童剂量为4mg，每日一次（E错，为本题正确答案）。